胆色素不包括
A. 胆素
B. 胆素原
C. 胆绿素
D. 胆红素
E. 胆黄素

正确答案：E。胆黄素

解析：胆色素是体内铁卟啉类化合物的主要分解代谢产物，包括胆绿素、胆红素、胆素原和胆素。胆红素的生成、运输、转化及排泄异常关联临床诸多病理生理过程。掌握“胆色素代谢”知识点。